功能疏散风热、透疹止痒、明目退翳、息风止痉的药物是
A. 薄荷
B. 牛蒡子
C. 蝉蜕
D. 葛根
E. 升麻

正确答案：C。蝉蜕

解析：本题考查的是蝉蜕的功效。功能疏散风热、透疹止痒、明目退翳、息风止痉的药物是蝉蜕（C对）。蝉蜕：【功效】疏散风热，透疹止痒，明目退翳，息风止痉。薄荷（A错）：【功效】宣散风热，清利头目，利咽，透疹，疏肝。牛蒡子（B错）：【功效】疏散风热，宣肺利咽，解毒透疹，消肿疗疮。葛根（D错）：【功效】解肌退热，透疹，生津，升阳止泻。升麻（E错）：【功效】发表透疹，清热解毒，升举阳气。